患者，男，40岁。素有高血压病史，现症见眩晕耳鸣，面红头胀，腰膝疫软，失眠多梦，时有遗精或性欲亢进，舌红，脉沉弦细。其病机是
A. 阴虚内热
B. 阴损及阳
C. 阴虚阳亢
D. 阳损及阴
E. 阴虚火旺

正确答案：C。阴虚阳亢

解析：阴虚阳亢，阴虚指精血或津液的亏虚。一般在正常状态下，阴和阳是相对平衡的，相互制约而协调。阴气亏损，阳气失去制约，就会产生亢盛的病理变化，生理病理性功能亢进，称为“阳亢”。因此，阴虚会引起阳气亢盛，阳亢则能使阴液耗损，两者互为因果。临床表现有潮热，颧红，盗汗，五心烦热，咳血，视物不清，消瘦或失眠，麻木拘急，烦躁易思，或遗精，性欲亢进，舌红而干等。该患者既有肾阴虚的症状，又有遗精或性欲亢进等阳气亢盛的症状（C对）。